对苯海拉明，哪项错误
A. 可用于失眠的患者
B. 可用于治疗荨麻疹
C. 是H₁受体阻断药
D. 可治疗胃和十二指肠溃疡
E. 可治疗过敏性鼻炎

正确答案：D。可治疗胃和十二指肠溃疡